男，3个月。健康婴儿。体重5Kg，用牛奶喂养，一般每天应给予8%糖牛奶和另给水分的量分别是
A. 450ml和200ml
B. 500ml和300ml
C. 550ml和200ml
D. 600ml和100ml
E. 650ml和200ml

正确答案：C。550ml和200ml

解析：每天应给予8%糖牛奶和另给水分的量分别为500ml和300ml的原因是：（1）婴儿能量需要量约为100kcal/（kg·d），8%糖牛乳100ml供能约100kacl/（kg·d），所以5kg婴儿所需总热量为500kcal/d，所需8%糖牛乳为500ml。（2）婴儿所需总液量（奶与水量）为150ml/（kg·d），所以另给水分的量=总液量-糖牛乳量=150×5-500=250ml。需要注意的事，老板教材中和新教材的数据差异（老教材是8%糖牛乳100ml供能约100kacl/（kg·d），每日所需能量也是110kcal/（kg·d）），根据老版本教材得出的数据是需要糖牛奶550ml，另加水分是150×5-550=200ml（C对）。但根据九版儿科学教材，婴儿每天能量需要量约为90kcal/（kg·d），8%糖牛乳100ml供能约100kacl/（kg·d），所以5kg婴儿所需总热量为500kcal/d，所需8%糖牛乳为450ml，另给水分的量=总液量-糖牛乳量=150×5-450=300ml。所以按九版教材本题答案应该是450ml，300ml。